治疗瘀血停胃证的主方为
A. 失笑散
B. 丹参饮
C. 血府逐瘀汤
D. 桃红四物汤
E. 失笑散合丹参饮

正确答案：E。失笑散合丹参饮

解析：胃痛日久不愈，病及血分，血行不畅，内生瘀血，阻遏胃络，治疗宜用失笑散合丹参饮；失笑散活血行淤，散结止痛；丹参饮调气化瘀（E对AB错）。血府逐瘀汤功效活血化瘀，行气止痛，主治胸中血瘀证（C错）。桃红四物汤功用养血活血，主治血虚兼血瘀证（D错）。